近端小管对葡萄糖重吸收的关键途径是
A. 基侧膜上的Na⁺泵
B. 管腔膜上的同向转运
C. 腔膜上的逆向转运
D. 管腔膜上的电中性转运
E. 管腔膜上的生电性转运

正确答案：B。管腔膜上的同向转运